诊断类风湿性关节炎最有意义的实验室指标是
A. 血清抗链球菌溶血素"O"阳性
B. 抗链激酶阳性
C. 抗透明质酸酶阳性
D. 血沉加快
E. 类风湿因子阳性

正确答案：E。类风湿因子阳性

解析：RA诊断标准：类风湿因子阳性（滴度＞1:20）。类风湿因子（RF）可分为IgM型、IgG型、IgA型RF，70%者血清检测IgM型RF阳性。RF是RA的非特异性抗体，诊断RA必须与临床表现结合（E对）。风湿热、急性肾小球肾炎、结节性红斑、猩红热、急性扁桃体炎等链球菌溶血素O抗体（ASO）明显升高（A错）。抗链激酶阳性不能诊断类风湿性关节炎（B错）。风湿热患者血清抗透明质酸酶呈阳性反应。其他A组溶血性链球菌感染相关性疾病如急性肾小球肾炎、扁桃腺炎等，血清抗透明质酸酶也可升高。抗透明质酸酶升高为存在链球菌感染的证据，而不是风湿热的直接证明（C错）。类风湿性关节炎的实验室检查：炎性标志物，血沉和C反应蛋白在疾病活动期常升高，并与病情活动度相关，血沉的特异性不如类风湿因子（D错）。